流行病学研究的观察法与实验法的根本区别在于
A. 盲法分
B. 是否有人为干预
C. 统计学检验
D. 设立对照组
E. 不设立对照组

正确答案：B。是否有人为干预

解析：观察法就是不对研究的客体进行干预和操作，所做的研究没有对研究的对象产生影响，仅仅是被动的接收信息进行观察。而实验法对研究的客体进行了干预和操作，研究对研究的对象产生了一些影响，是一种较为主动的研究方法。观察法和实验法之间最根本的区别就是，是否有人为干预（B对）。